绝经后骨质疏松且无禁忌症患者，在钙剂+维生素D的基础治疗上，宜选用
A. 雌激素或雌激素受体调节剂
B. 双膦酸盐
C. 降钙素
D. 雄激素
E. 孕激素

正确答案：A。雌激素或雌激素受体调节剂

解析：本题考查骨质疏松症的药物治疗。在基础治疗即钙制剂+VD的基础上，联合雌激素用药，须注意适应证与禁忌症，当没有激素替代治疗（HRT）禁忌症的基础上才可以选用雌激素或选择性雌激素受体调节剂（A对）治疗。老年性骨质疏松患者，在钙剂+维生素D的基础治疗上，宜选用双膦酸盐组成三联制剂，从而进行骨质疏松的治疗，此外，应用糖皮质激素引起的骨质疏松患者，宜选用双膦酸盐（B错）。骨质疏松症引起的关节疼痛，宜选用降钙素（C错）。